八纲中的“寒热”是指
A. 辨病位的纲领
B. 辨病性的纲领
C. 辨虚实的纲领
D. 辨病因的纲领
E. 辨标本的纲领

正确答案：B。辨病性的纲领

解析：寒、热是辨别疾病性质的两个纲领（B对）。表、里是辨别病变部位外内、浅深的两个纲领（A错）。虚、实是辨别邪正盛衰的两个纲领（C错）。阴、阳是归类病证类别的两个纲领。辨病因的纲领为外感与内伤（D错）。